病例对照研究中，选择偏倚不包括
A. 入院率偏倚
B. 回忆偏倚
C. 检出症候偏倚
D. 无应答偏倚
E. 错误分类偏倚

正确答案：B。回忆偏倚

解析：信息偏倚又称观察偏倚或错误分类偏倚（E对），常见的信息偏倚是：（1）回忆偏倚（B对），（2）报告偏倚，（3）诊断怀疑偏倚，（4）暴露怀疑偏倚，（5）测量偏倚，（6）发表偏倚。常见的选择偏倚是：（1）入院率偏倚（A错），（2）检出症候偏倚（C错），（3）现患病例-新发病例偏倚，（4）无应答偏倚（D错），（5）失访偏倚，（6）易感性偏倚。所以选择偏倚不包括回忆偏倚、错误分类偏倚，BE均正确。